支配肱三头肌
A. 桡神经
B. 腋神经
C. 肌皮神经
D. 正中神经
E. 尺神经

正确答案：A。桡神经

解析：桡神经（A对）布于肱三头肌、肘肌、肱桡肌和桡侧腕长伸肌。腋神经（B错）支配三角肌和小圆肌。肌皮神经（C错）支配喙肱肌和肱二头肌。正中神经（D错）运动纤维支配第1、2蚓状肌和鱼际肌（拇收肌除外），感觉纤维则分布于桡侧半手掌、桡侧三个半手指掌面皮肤及其中节和远节指背皮肤。尺神经（E错）浅支分布于小鱼际表面的皮肤、小指掌面皮肤和环指尺侧半掌面皮肤，深支分布于小鱼际肌、拇收肌、骨间掌侧肌、骨间背侧肌及第3、4蚓状肌。